黄斑
A. 位于视神经盘鼻侧35cm处
B. 其中央凹陷称中央凹
C. 中央凹血管丰富，感光最敏锐
D. 中央凹由密集的视杆细胞构成
E. 无

正确答案：B。其中央凹陷称中央凹

解析：黄斑位于视神经盘颞侧3.5mm处（A错），其中央的凹陷称中央凹（B对）。中央凹无血管（C错），且由密集的视锥细胞构成（D错），故感光最敏锐。